吗啡造成强迫性觅药行为的原因是
A. 便秘
B. 针尖样瞳孔
C. 呕吐
D. 耐受性
E. 依赖性

正确答案：E。依赖性

解析：依赖性又分为躯体依赖性（即成瘾性）和精神依赖性（即习惯性）。精神依赖性则使患者产生一种继续需求药物的病态心理。成瘾者为追求吗啡的欣快感及避免停药所致戒断症状的痛苦，常不择手段、千方百计来获取和使用药物，称为"强迫性觅药行为"（E对）。